检查阿司匹林中的水杨酸的方法是
A. 分光光度法
B. 重氮化-偶合比色法
C. 三氯化铁反应
D. 双相滴定法
E. 分离后酸碱滴定法

正确答案：C。三氯化铁反应